患者冻疮，手足冷痛，有冻疮，面色苍白，唇爪不华，脉细欲绝，舌淡，苔薄白，治宜
A. 四逆散
B. 白通汤
C. 四逆汤
D. 通脉四逆汤
E. 当归四逆汤

正确答案：E。当归四逆汤

解析：手足厥寒，当察气血阴阳，辨其寒热虚实。四肢逆冷，脉微欲绝，属少阴阳衰、阴寒内盛之寒厥证。今手足冷痛，面色苍白，唇爪不华，脉细欲绝，即本证厥逆的程度较寒厥证的四肢逆冷为轻。脉细欲绝与脉微欲绝有别，细主血虚，微主阳虚。本证手足厥寒与脉细欲绝并见，结合舌淡，苔薄白，是血虚感寒，寒凝经脉，气血运行不畅，四末失于温养所致，故治以当归四逆汤养血通脉，通经散寒（E对）。